在经皮给药系统（TDDS）中，可作为保护膜材料的有
A. 聚乙烯醇
B. 醋酸纤维素
C. 聚苯乙烯
D. 聚乙烯
E. 羟丙基甲基纤维素

正确答案：C、D。聚苯乙烯；聚乙烯

解析：本题考查经皮给药制剂的处方材料。聚乙烯（D对）、聚苯乙烯（C对）可作为保护膜材料。聚乙烯醇（A错）和羟丙基甲基纤维素（E错）常作为药库材料；醋酸纤维素（B错）常作为背衬层。